下颌第一双尖牙形态中哪一点是错误的
A. 可见近中沟
B. 唇面五边形
C. 颊尖明显大于舌尖
D. 可见横嵴
E. 牙冠舌倾

正确答案：A。可见近中沟

解析：本题考查下颌第一双尖牙的形态特点。可见近中沟（A错，为本题正确答案）不符合下颌第一双尖牙的形态特点。近中沟是上颌第一双尖牙特有的解剖标志，下颌第一双尖牙近中沟跨过边缘嵴到达了舌面，称近中舌沟。下颌第一双尖牙唇面近似五边形（B对），颊尖长大而尖锐，明显大于舌尖（C对）。牙合面可见横嵴（D对），由颊尖三角嵴和舌尖三角嵴相连横过牙合面形成，是该牙的重要解剖标志。相对于上颌双尖牙，下颌双尖牙的牙冠舌倾明显（E对），颊尖接近牙体长轴或位于牙体长轴上。